以上牙周膜纤维中符合水平组纤维的特点的是
A. 牙周膜中数量最多、力量最强的一组纤维
B. 呈放射状止于根尖周围的牙槽骨
C. 是维持牙齿直立的主要力量，防止牙齿侧方移动
D. 可以防止牙齿根部向冠方移动的作用
E. 主要分布在牙齿的颊舌侧，邻面无此纤维

正确答案：C。是维持牙齿直立的主要力量，防止牙齿侧方移动

解析：本题考查牙周膜。水平组：位于牙槽嵴纤维的根方，呈水平方向分布。是维持牙齿直立的主要力量，并与牙槽嵴纤维共同对抗侧向力，防止牙齿侧方移动（C对）。